以下各项中不适合采取第一级预防的是
A. 职业病
B. 心血管疾病
C. 病因不明，难以觉察预料的病
D. 脑卒中
E. 糖尿病

正确答案：C。病因不明，难以觉察预料的病

解析：第一级预防：是针对病因所采取的预防措施。它既包括针对健康个体的措施也包括针对整个公众的社会措施。在第一级预防中，如果在疾病的因子还没有进入环境之前就采取预防性措施，则称为根本性预防。掌握“预防医学概论、健康及三级预防策略”知识点。